保健食品的特征不包括
A. 属于食品
B. 不是药物
C. 有特定的保健功能
D. 以治疗疾病为目的
E. 适于特定人群食用

正确答案：D。以治疗疾病为目的